中医学女性生殖轴的概念是
A. 脑—肾—天癸—胞宫
B. 天癸—冲任—气血—胞宫
C. 肾—天癸—气血—胞宫
D. 肾—天癸—冲任—胞宫
E. 天癸—肾—冲任—胞宫

正确答案：D。肾—天癸—冲任—胞宫

解析：“中医天癸古今论”者提出：“根据古今对天癸的认识及“脑为元神之府”和肾主髓通脑的理论，提出脑-肾-天癸-冲任轴为性生殖机能调节系统的新概念，主司月经生理（A错）。天癸是肾精肾气充盛到一定程度时体内出现的具有促进人体生长、发育和生殖的一种精微物质。天癸来源于先天，藏之于肾，故其盛衰皆与肾气相关。所以女性生殖轴离不开肾，而天癸藏之于肾（B错）。对妇女来说，“天癸至”，则“月事以时下，故有子”，“天癸竭，地道不通，故形坏而无子也”，说明天癸使任脉所司的精、血、津液旺盛、充沛、通达，并使冲脉在其作用下，广聚脏腑之血而血盛，冲任二脉相资，血海满溢，月经来潮。而天癸藏之于肾，冲任二脉亦依赖天癸而使血盛，为女性生殖轴的关键。而气血则是生命延续所必需的精微物质（C错）。现代有中医学者根据《内经》理论和西医学相关观点，从肾、天癸、冲任、胞宫之间的关系及其调节指导了调经、助孕、安胎等系列研究，逐渐形成了中医学的肾-天癸-冲任-胞宫轴概念，月经周期由此轴进行调节。肾、天癸、冲任、胞宫是产生月经的中心环节，各环节之间互相联系，不可分割，称之为“肾-天癸-冲任-胞宫轴”（D对）。天癸来源于先天，为先天之精，藏之于肾，肾精肾气充盛到一定程度才可产生天癸，故生殖轴中肾应当置于天癸之前。（E错）。